女孩，2岁。生长发育迟缓及智力发育落后。查体：眼裂小眼外毗上斜、眼距宽、外耳小、鼻梁低平，皮肤细腻。为明确诊断首选的检查是
A. 尿三氯化铁试验
B. 尿蝶呤分析
C. 血T₃、T₄、TSH
D. 骨龄测定
E. 染色体核型分析

正确答案：E。染色体核型分析

解析：患儿，生长发育和智力发育落后，并且有眼裂小眼外毗上斜眼距宽外耳小鼻梁低平、皮肤细腻的特殊面容，应诊断为唐氏综合症，唐氏综合症是染色体病性遗传病，因此，确诊方法是染色体核型分析（E对）。尿三氯化铁试验（A错）和尿蝶呤分析（B错）都是用来诊断苯丙酮尿症的方法。血T3T4TSH是甲亢或甲减的确诊方法（C错）。骨龄测定对维生素D缺乏性佝偻病有辅助检查的价值（D错）。